具有温经化痰散瘀通络功效的方剂是
A. 黄芪桂枝五物汤
B. 小活络丹
C. 补阳还五汤
D. 阳和汤
E. 当归四逆汤

正确答案：B。小活络丹

解析：小活络丹大辛大热之川乌、草乌，祛风散寒除湿，温经通络；天南星化痰；地龙通络；乳香、没药主以活血化瘀止痛。诸药合用，共奏温经化痰，散瘀通络之效（B对）。黄芪桂枝五物汤功效为益气温经，和血通痹（A错）。补阳还五汤功效为补气活血通络（C错）。阳和汤的功用为温阳补血，散寒通滞（D错）。当归四逆汤功效为温经散寒，养血通脉（E错）。